就服务内容而言，社区卫生服务中的综合性服务包括
A. 病人和非病人
B. 生理、心理和社会文化各方面
C. 预防、治疗和康复
D. 个人、家庭和社区
E. 现代医学、传统医学、替代医学的知识和技能

正确答案：C。预防、治疗和康复

解析：本题考查社区卫生服务的综合性特点。社区卫生服务的综合性特点，就服务内容而言，包括健康教育、预防、医疗、保健、康复（C对ABDE错）、计划生育技术指导等。